经产妇，31岁。现妊娠35周。查体：BP120/80mmHg，宫底35cm，胎心136次/分。空腹血糖6.2mmol/L，尿糖（+）。2年前因妊娠8个月死胎行引产术。对该患者最有意义的辅助检查是
A. 葡萄糖耐量试验
B. 血常规
C. 尿常规
D. 尿雌三醇
E. 血生化检查

正确答案：A。葡萄糖耐量试验

解析：该患者妊娠35周，空腹血糖6.2mmol/L（空腹血糖正常值为3.9～6.1mmol/L，6.1～7.0mmol/L提示空腹血糖受损，≥7.0mmol/L为糖尿病），尿糖（+），考虑可能为妊娠期糖尿病（GDM），故应对其进行葡萄糖耐量试验（A对）进行确诊。诊断标准：空腹及服糖后1、2小时的血糖值分别为5.1mmol/L、10.0mmol/L、8.5mmol/L。任何一点血糖值达到或超过上述标准即诊断为GDM。尿雌三醇（P152）（D错）用于评估胎儿胎盘功能；血常规（B错）、尿常规（C错）、血生化检查（E错）对诊断妊娠期糖尿病没有价值。